上皮层中胞质内含嗜碱性透明角质颗粒的细胞是
A. 角化层
B. 颗粒层
C. 棘层
D. 基底层
E. 黑色素细胞

正确答案：B。颗粒层

解析：粒层：位于角化层的深面，棘细胞层的浅面，一般由2～3层扁平细胞组成。胞质中含有嗜碱性透明角质颗粒。掌握“口腔黏膜基本结构”知识点。